属于非离子表面活性剂的是
A. 硬脂酸钾
B. 泊洛沙姆
C. 十二烷基硫酸钠
D. 十二烷基磺酸钠
E. 苯扎氯铵

正确答案：B。泊洛沙姆

解析：本题考查非离子型表面活性剂。泊洛沙姆（B对）为非离子表面活性剂；硬脂酸钾（A错）、十二烷基硫酸钠（C错）、 十二烷基磺酸钠（D错）均为阴离子表面活性剂；苯扎氯按（E错）为阳离子表面活性剂。